为规范药品零售环节经营行为，某地药品监督管理部门对辖区内药品零售企业开展监督检查。检查发现（1）甲药品零售企业涉嫌从非法渠道购进药品，部分批号的阿卡波糖片不能提供购进发票，且经追测码查询，供货单位系某医疗机构：涉嫌违规经营米非司酮片。（2）乙药品零售企业屡次绕开计算机系统销售过期的盐酸二甲双胍缓释片、二甲双胍格列本脲胶囊等药品；计算机系统中有多条超数量销售含麻黄碱类复方制剂的销售记录，其中最多一次销售了50盒，企业留存了本次销售的处方。甲违规经营的米非司酮片，其药品种类是
A. 用于紧急避孕的非处方药
B. 具有终止妊娠作用的药品
C. 第二类精神药品
D. 含兴奋剂药品

正确答案：B。具有终止妊娠作用的药品

解析：本题考查的是药品零售经营的禁止类行为。为规范药品零售环节经营行为，某地药品监督管理部门对辖区内药品零售企业开展监督检查。检查发现（1）甲药品零售企业涉嫌从非法渠道购进药品，部分批号的阿卡波糖片不能提供购进发票，且经追测码查询，供货单位系某医疗机构：涉嫌违规经营米非司酮片。（2）乙药品零售企业屡次绕开计算机系统销售过期的盐酸二甲双胍缓释片、二甲双胍格列本脲胶囊等药品；计算机系统中有多条超数量销售含麻黄碱类复方制剂的销售记录，其中最多一次销售了50盒，企业留存了本次销售的处方。甲违规经营的米非司酮片，其药品种类是具有终止妊娠作用的药品（B对）。药品零售企业不得销售米非司酮（含仅用于紧急避孕或用于治疗子宫肌瘤的米非司酮制剂）等具有终止妊娠作用的药品。用于紧急避孕的非处方药（A错）为单方孕激素类紧急避孕药，成分多为左炔诺孕酮。第二类精神药品（C错）包括29个品种，具体为1.异戊巴比妥2.格鲁米特3.喷他佐辛4戊巴比妥5.阿普唑仑6.巴比妥7.氯氮䓬8.氯硝西泮9.地西泮10.艾司唑仑11.氟西泮12.劳拉西泮13.甲丙氨酯14.咪达唑仑15.硝西泮16.奥沙西泮17.匹莫林18.苯巴比妥19.唑吡坦20.丁丙诺啡透皮贴剂21.布托啡诺及其注射剂22.咖啡因23.安钠咖24.地佐辛及其注射剂25.麦角胺咖啡因片26.氨酚氢可酮片27.曲马多28.扎来普隆29.佐匹克隆。含兴奋剂药品（D错）品种有①蛋白同化制剂品种87个。②肽类激素品种65个。③麻醉药品品种14个。④刺激剂（含精神药品）品种75个。⑤药品类易制毒化学品品种3个。⑥医疗用毒性药品品种1个。⑦其他品种（β受体阻滞剂、利尿剂等）。